健康管理的首要一般步骤为
A. 预防危害健康风险
B. 收集健康信息
C. 制定完善的健康计划
D. 疾病危险度评估
E. 健康维护计划的实施

正确答案：B。收集健康信息

解析：健康管理的首要步骤一般为收集健康信息（B对），健康信息一般通过问卷调查，健康体检和筛查等获得：第二步为健康危险度评估，即健康和疾病危险度评估（D错）：第三步为个体化健康维护计划的制定（C错）：第四步为个体化健康维护计划的实施（E错）。